与多柔比星存在交叉耐药性的抗肿瘤药物是
A. 右雷佐生
B. 柔红霉素
C. 阿糖胞苷
D. 甲氨蝶呤
E. 环磷酰胺

正确答案：B。柔红霉素

解析：本题考查药物相互作用。与多柔比星存在交叉耐药性的抗肿瘤药物是柔红霉素（B对）。多柔比星与柔红霉素、长春新碱和放线菌素D呈现交叉耐药性；与甲氨蝶呤（D错）、氟尿嘧啶、阿糖胞苷（C错）、氮芥、丝裂霉素、博来霉素、环磷酰胺（E错）以及亚硝脲等则不呈现交叉耐药性。右雷佐生（A错）是用于减轻或减少蒽环类抗生素（如多柔比星）化疗引起的心肌毒性的一种抗肿瘤辅助药品。